患儿7岁，6萌2/3，E早失。应选择何种保持器更好
A. 带环丝圈保持器
B. 全冠丝圈保持器
C. 带环远中导板保持器
D. 全冠远中导板保持器
E. 活动功能式保持器

正确答案：D。全冠远中导板保持器

解析：本题考查间隙保持器的种类及适应证。全冠远中导板式间隙保持器（D对）适用于第二乳磨牙早失、第一恒牙尚未萌出或萌出中，此患者符合。带环远中导板保持器（C错）因带环与导板焊接处易出现问题，不常用。带环丝圈保持器（A错）、全冠丝圈保持器（B错）适用于单侧第一乳磨牙早失，第一恒磨牙萌出后，第二乳磨牙单侧早期丧失的病例。活动功能式保持器（E错）适用于乳磨牙缺失两个以上者，或两侧乳磨牙缺失，或伴有前牙缺失。